某患者检查结果为：血氧容量12ml/dl,动脉血氧含量11.4ml/dl,动脉血氧分压13.3kPa(lOOmmHg),动－静脉氧含量差3.5ml/dl。该患者为下列何种疾病的可能性大？
A. 慢性支气管炎
B. 矽肺
C. 慢性充血性心力衰竭
D. 慢性贫血
E. 严重维生素B2缺乏

正确答案：D。慢性贫血

解析：该患者的检查结果与正常值相比，血氧容量降低、动脉血氧含量降低、动脉血氧分压正常、动-静脉氧含量差降低，这些都符合血液性缺氧的血氧变化特点。慢性支气管炎（A错）、矽肺（B错）是引起乏氧性缺氧的原因。慢性充血性心力衰竭（C错）是引起循环性缺氧的原因。严重维生素B2缺乏（E错）是引起组织性缺氧的原因。慢性贫血（D对）是引起血液性缺氧的原因。